肌肉活动的能量来源为
A. ATP-CP系列
B. 需氧系列
C. 乳酸系列
D. 以上都是
E. 以上都不是

正确答案：D。以上都是